男性，50岁。平时常有头痛头晕，视物模糊，转头时突然跌倒。经检查临床诊断为颈椎病，其最可能的类型是
A. 神经根型
B. 脊髓型
C. 交感神经型
D. 椎动脉型
E. 混合型

正确答案：D。椎动脉型

解析：椎动脉型颈椎病症状以发作性眩晕为主，眩晕发作与颈部旋转或后伸运动或体位急剧变动有关，以伴有复视及无意识障碍的猝倒为特征，与患者表现相符，故其最可能的类型是椎动脉型（D对）。神经根型颈椎病（P726）（A错）表现为颈肩痛，同时伴有神经根支配区域的感觉减弱、感觉过敏、肌力减弱、肌萎缩等症状，其特点是臂丛神经牵拉实验和压头试验阳性。脊髓型颈椎病（P727）（B错）常表现为上肢或下肢麻木无力、僵硬、双足踩棉花感，足尖不能离地，触觉障碍、束胸感，双手精细动作笨拙，不能用筷子进食，肌力减退，四肢腱反射活跃或亢进，Hoffmann征、髌阵挛、踝阵挛及Babinski征等阳性。交感神经型颈椎病（P727）（C错）主要表现为交感神经受刺激的症状，可为兴奋性也可为抑制性。混合型颈椎病（E错）多有两种或多种类型症状同时出现。